某患者因右眼球胀痛、视物模糊入院诊治，检查发现右眼球变硬，眼压升高（7.8kPa），诊断为青光眼。其诊断依据是
A. 晶状体混浊
B. 虹膜炎症
C. 睫状体分泌房水受阻
D. 巩膜静脉窦回流房水受阻
E. 玻璃体混浊

正确答案：D。巩膜静脉窦回流房水受阻

解析：患者因右眼胀痛、视物模糊就诊，检查发现眼压升高（7.9kPa），提示巩膜静脉窦回流房水受阻（D对），故诊断为青光眼。